与肾相关的官窍有
A. 耳
B. 前阴
C. 后阴
D. 眼目
E. 鼻喉

正确答案：A、B、C。耳；前阴；后阴